患者戴用全口义齿一月，复查时自述戴牙后一直感觉咀嚼无力，面部酸痛。如果检查发现息止（牙合）间隙过大，最好的处理方法是
A. 重衬
B. 自凝塑料加高咬合
C. 嘱患者慢慢适应
D. 修改（牙合）面形态
E. 重新制作

正确答案：B。自凝塑料加高咬合

解析：本题考查戴用义齿后可能出现的问题及处理。患者自述戴牙后一直感觉咀嚼无力，面部酸痛，检查发现息止（牙合）间隙过大，说明全口义齿垂直距离恢复的过小。此种情况可用自凝塑料加高咬合以补偿过低的垂直距离（B对）。由于垂直距离恢复得过低或过高，改变了咀嚼肌肌张力和颞颌关节正常状态，患者常感到肌疲劳和酸痛、张口受限等颞颌关节症状，可通过加高或降低垂直距离和调牙合来解决。对于比较严重的病例，则需重新制作。重衬（A错）用于解决因牙槽骨吸收而导致的义齿固位不良、义齿与黏膜之间不密合的问题。嘱患者慢慢适应（C错）是错误的，长时间使用垂直距离恢复不当的义齿，会导致患者出现颞下颌关节疾病，咀嚼无力等严重后果。修改（牙合）面形态（D错）用于解决义齿（牙合）关系不正确的问题，不能用于改善过小的垂直距离。重新制作（E错）可以解决义齿存在的大部分问题，也是一种解决办法，但重新制作耗时长，患者又要经历一段时间的无牙期，不是最好的处理办法。